男，48岁。长期大量饮酒，自行戒酒2天后，出现心悸、大汗、双手震颤、兴奋激越、烦躁不安，晚上还说看见有鬼。对该患者目前的治疗方案不恰当的是
A. 饮酒缓解戒断症状
B. 用地西泮缓解戒断症状
C. 预防感染
D. 抗精神病药物控制兴奋状态
E. 补充水、电解质、B族维生素

正确答案：A。饮酒缓解戒断症状

解析：患者长期大量饮酒，戒酒2天后出现心悸、大汗、双手震颤、兴奋激越、烦躁不安，晚上说看见有鬼（典型的酒精戒断反应）。对于患者酒精戒断反应的治疗有：1.一般注意事项：需要安静环境，他人看护，注意保温，预防感染（C对）；2.镇静：首选苯二氮䓬类，如地西泮（B对）每次10mg，2-3次/日；3.控制精神症状（D对）：氟哌啶醇，每次5mg，1-3次/日；4.纠正水、电解质和酸碱平衡紊乱，补充大剂量维生素（E对）等。酒精与苯二氮䓬类药理作用相似，临床上用以缓解酒精戒断症状，而不是用饮酒方式缓解（A错，为本题的正确答案）。